神经肌肉应激性增高可见于
A. 高钙血症
B. 低镁血症
C. 低磷血症
D. 低钾血症
E. 酸中毒

正确答案：B。低镁血症

解析：Mg2+和Ca2+竞争进入轴突，低镁血症（B对）时则Ca2+进入增多，导致轴突释放乙酰胆碱增多，使神经-肌肉接头处兴奋传递加强。高钙血症（A错）可使神经、肌肉兴奋性降低。低磷血症（C错）使神经肌肉应激性降低。低钾血症（D错）时细胞兴奋性降低。酸中毒（E错）时细胞外液H+增多影响Ca2+内流，细胞兴奋性降低。